临终关怀的伦理意义表现在
A. 它有利于建立和谐社会
B. 它体现生命神圣、质量和价值的统一
C. 它理解临终患者的需求
D. 它维护临终患者的生命尊严
E. 它同情和关心临终患者的家属

正确答案：B。它体现生命神圣、质量和价值的统一